某女，35岁。出现表情淡漠，寡言少语，闷闷不乐，哭笑无常等症状，其临床意义是
A. 失神
B. 少神
C. 假神
D. 神乱
E. 无神

正确答案：D。神乱

解析：本题考查的是望神的临床表现和意义。出现表情淡漠，寡言少语，闷闷不乐，哭笑无常等症状，其临床意义是神乱（D对）。望神，就是观察患者的精神好坏、意识是否清楚、动作是否矫健协调、反应是否灵敏等方面的情况，以判断脏腑阴阳气血的盛衰和疾病的轻重预后。由于“目”为五脏六腑精气之所注，其目系通于脑，为肝之窍，心之使，“神藏于心，外候在目”，所以察眼神的变化又是望神的重要内容之一。1.有神的临床表现及意义：在疾病过程中，如患者两眼灵活、明亮有神、鉴识精明、神志清楚、反应灵敏、语言清晰，称为“有神”或“得神”。神以精气为基础，故精气充盛则神旺，而精气表现于两目比较突出。“有神”，表示正气未伤，脏腑功能未衰，即使病情较重，预后亦多良好。2.失神（A错）的临床表现及意义：在疾病过程中，如患者表现为目光晦暗、瞳仁呆滞、精神萎靡、反应迟钝、呼吸气微，甚至神识昏迷、循衣摸床、撮空理线，或猝倒而目闭口开、手撒、遗尿等，均称为“失神”或“无神（E错）”。“失神”，表示正气已伤，病情严重，预后不好。3.假神（C错）的临床表现和意义：在疾病过程中，如患者原来不欲言语、语声低弱、时断时续、突然转为言语不休；原来精神极度衰颓、意识不清、突然精神转“佳”；原来面色十分晦暗、忽然两颧发红如妆，都属于假神，是为阴阳格拒，阴不敛阳，欲将离决的虚假现象，人们通常把它比喻为“回光返照”或“残灯复明”，应予以特别注意。假神，往往见于久病、重病、精气极度衰弱的患者，表示正气大伤，病情严重又复杂，预后不良。4.神乱的临床表现及意义：神乱，即神志异常。在疾病过程中，如患者表情淡漠、寡言少语、闷闷不乐，继则精神呆滞、哭笑无常的，多为痰气凝结、阻蔽心神的癫病；烦躁不宁、登高而歌、弃衣而走、呼号怒骂、打人毁物、不避亲疏，多属痰火扰心的狂病；若突然跌仆、昏不知人、口吐涎沫、四肢抽动，多属痰迷心窍、肝风内动的痫病。神乱，常见于癫、狂、痫的患者。少神（B错）的临床表现和意义，2022年考试指南未明确说明。少神的临床表现和意义：少神，又称“神气不足”。临床表现为两目晦滞，目光乏神，面色少华，暗淡不荣，精神不振，思维迟钝，少气懒言，肌肉松软，动作迟缓。临床意义为提示精气不足，机能减退，多见于虚证患者或疾病恢复期病人。